平均装量在6.0g以上时，颗粒剂的装量差异限度要求是
A. ±5%
B. ±7%
C. ±8%
D. ±10%
E. ±15%

正确答案：A。±5%

解析：本题考查散剂的装量差异限度。散剂的装量差异限度：标示装量≤0.1g的差异限度为±15%（E错），0.1g以上～0.5g的差异限度为±10%（D错），0.5g以上～1.5g的差异限度为±8%（C错），1.5g以上～6.0g的差异限度为±7%（B错），6.0g以上为±5%（A对）。